药剂学的任务包括
A. 基本理论的研究
B. 新剂型的研究与开发
C. 新辅料的研究与开发
D. 生物技术药物制剂的研究与开发
E. 医药新技术的研究与开发

正确答案：A、B、C、D、E。基本理论的研究；新剂型的研究与开发；新辅料的研究与开发；生物技术药物制剂的研究与开发；医药新技术的研究与开发

解析：本题考查药剂学的任务。药剂学的具体任务可归纳如下：①药剂学基本理论的研究（A对）；②新剂型的研究与开发（B对）；③新技术的研究与开发；③新技术的研究与开发；④新辅料的研究与开发（C对）；⑤中药新剂型的研究与开发；⑥生物技术药物制剂的研究与开发（D对）；⑦制剂新机械和新设备的研究与开发。